下列各项，属麻痹性肠梗阻表现的是
A. 腹部胀痛
B. 腹部绞痛
C. 肠形及蠕动波
D. 肠鸣音呈金属音调
E. 频繁排气排便

正确答案：A。腹部胀痛

解析：麻痹性肠梗阻表现的是腹部胀痛。腹部胀痛可能是肠道痉挛性疼痛所引起的，还可能是由于功能性消化不良、慢性结肠炎、肠道菌群失调导致肠道产气增多（A对）。腹部绞痛最为常见的还是消化系统疾病所引起。比如有肠系膜动脉栓塞、肠系膜栓塞综合征、胃溃疡、十二指肠球部溃疡、胆囊结石、急性胆囊炎、急性化脓性胆管炎、机械性肠梗阻、肠套叠、肠扭转，或肠道寄生虫等。另外大量摄入生冷食品，或者是暴饮暴食、吞气，也可以引起胃肠道痉挛，出现腹部绞痛。同时输尿管结石也可以造成剧烈的腹部绞痛，可伴有血尿或腹痛的症状（B错）。肠梗阻时可看到肠蠕动波及肠型（C错）。肠鸣音次数增多，且响亮、高亢，甚至呈金属音者，称肠鸣音亢进，见于机械性肠梗阻，系因肠腔梗阻，积气增多，肠壁被胀大变薄而极度紧张，使亢进的肠鸣音产生共鸣所致（D错）。频繁排气排便考虑胃肠功能紊乱（E错）。